下列不属于维系蛋白质三级结构的化学键的是
A. 盐键
B. 氢键
C. 范德华力
D. 肽键
E. 疏水键

正确答案：D。肽键

解析：蛋白质分子中，维系一级结构的主要是肽键（D错，为本题正确答案）和二硫键；维系二级结构的主要是氢键；维系三级结构的是疏水键（E对）、盐键（A对）、氢键（B对）以及范德华力（C对）等；维系四级结构的主要是氢键和离子键。